乳牙急性根尖周炎的应急处理是
A. 开髓
B. 建立髓腔引流
C. 切开排脓
D. 给予抗菌药物的全身治疗
E. 以上均正确

正确答案：E。以上均正确

解析：本题考查乳牙急性根尖周炎的应急处理。乳牙急性根尖周炎的应急处理主要有1.开髓引流：在局麻下开髓（A对），疏通根尖孔，建立引流通道（B对），使根尖渗出物及脓液通过根管得到引流，以缓解根尖部的压力，解除疼痛。2.切开排脓（C对）：急性根尖周炎发展至骨膜下或黏膜下脓肿期应该在局部浸润麻醉或者表面麻醉下切开排脓。3.去除刺激：对于物理和化学药物引起的根尖周炎，应该去除刺激物，反复冲洗根管，重新封药，避免再感染。4.调磨咬合：对于牙外伤引起的急性根尖周炎，应调（牙合）使患牙咬合降低、功能减轻，必要时局部封闭或理疗。5.消炎止痛：一般可采用口服或者注射途径给予抗生素类药物或者止痛药物，也可局部封闭、理疗及针灸止痛，或给予抗菌药物的全身治疗（D对）。综上所述，以上都是（E对，为本题正确答案）乳牙急性根尖周炎的应急处理。